浅龋位于牙冠部时，一般为
A. 牙釉质龋
B. 牙骨质龋
C. 牙本质龋
D. 牙髓炎
E. 牙本质敏感

正确答案：A。牙釉质龋

解析：浅龋位于牙冠部时，一般均为釉质龋或者早期釉质龋。但若发生于牙颈部，则是牙骨质龋和（或）牙本质龋，亦有一开始就是牙本质龋者。掌握“龋病的临床表现与分类”知识点。